根据《麻醉药品和精神药品管理条例》，第二类精神药品专用账册的保存期限应当自药品有效期满之日起不少于
A. 1年
B. 2年
C. 3年
D. 4年
E. 5年

正确答案：E。5年

解析：本题考查第二类精神药品的储存。根据《麻醉药品和精神药品管理条例》，第二类精神药品专用账册的保存期限应当自药品有效期满之日起不少于5年（E对）。第二类精神药品经营企业，应当在药品库房中设立独立的专库或者专柜储存第二类精神药品，并建立专用账册，实行专人管理。专用账册的保存期限应当自药品有效期期满之日起不少于5年。